在使用辅助检查手段时，不适宜的是
A. 必要检查能尽早确定诊断和进行治疗
B. 应从患者的利益出发决定该做的项目
C. 认真严格地掌握适应症
D. 可以广泛积极地依赖各种辅助检查
E. 有利于提高医生诊治疾病的能力

正确答案：D。可以广泛积极地依赖各种辅助检查

解析：很多时候对疾病的诊断起着关键的作用，但医务人员不能盲目使用辅助检查（D错，为本题正确答案），应该遵循一下几点辅助检查要求：1根据患者的诊治需要、患者的耐受性等综合考虑确定检查项目，对诊治需要且患者又能耐受，即使做多项检查反复检查也是无可指责的，但是简单检查能解决问题就不要做复杂而危险的检查，少数几项检查能说明问题的就不要做更多的检查。2.医生确定了辅助检查的项目以后，一定要向患者和家属讲清楚检查的目的、意义、费用、医疗风险等，让其理解并表示同意后再进行检查，特别是一些比较复杂、费用昂贵或危险性较大的检查更应该得到患者的理解和同意。为了避免辅助检查的局限性，需要将辅助检查的结果和患者的病史、体格检查的资料一起综合分析，才能做出正确的诊断，切忌片面夸大辅助检查的诊断价值。同时临床医生应当同医技人员相互协作，共同完成对患者的诊断任务。如果出现辅助检查与临床检查不一致的地方，双方应主动协商沟通，通过沟通达成共识，以便更好地作出临床诊断。